轻度有机磷杀虫药中毒瞳孔变化情况是
A. 瞳孔缩小
B. 瞳孔扩大
C. 两侧瞳孔大小不等
D. 瞳孔形状不规则
E. 乳白色

正确答案：A。瞳孔缩小

解析：某些副交感神经和某些交感神经节后纤维的胆碱能毒蕈碱受体兴奋，则出现平滑肌收缩、腺体分泌增加、瞳孔收缩（A对）、恶心、呕吐、腹痛、腹泻等毒草碱样症状。使用扩瞳的药物，如阿托品、山莨菪碱等。眼内病变如青光眼、虹膜萎缩、眼外伤等。中枢神经系统的损害，包括脑卒中、脑外伤、颅内感染、颅内肿瘤，或导致中枢神经系统损害的中毒（B错）。生理性瞳孔不等大见于两眼屈光不等、两眼侧视时及侧光照明时。病理性瞳孔不等大见于眼部病变和颅内病变，眼部病变常见的有角膜炎、虹膜炎、虹膜后粘连、瞳孔括约肌损伤等；颅内病变。双侧瞳孔不等大且变化不定，提示中枢神经病变或虹膜的神经配障碍；如瞳孔不等且伴有对光反射减弱或消失以及神志不清，往往是中脑功能受损的表现（C错）。瞳孔形状不规则的原因有葡萄膜炎（这是最常见的原因，包括虹膜炎、虹膜睫状体炎或者全葡萄膜炎）、眼部外伤、先天性的发育异常（比如先天性虹膜缺损）、青光眼急性发作期过后（损伤虹膜的瞳孔括约肌）（D错）。瞳孔区域由黑变白，最常见的原因是老年性白内障（E错）。